1岁女婴，体重5kg，身高71cm，极度消瘦，神情呆滞，肌张力低下
A. Ⅰ度营养不良
B. Ⅱ度营养不良
C. Ⅲ度营养不良
D. 恶性度营养不良
E. 正常儿

正确答案：C。Ⅲ度营养不良

解析：本题考查营养不良的分度。1岁女婴儿平均体重为7.2Kg～11.2Kg，该名女婴体重5kg，体重较平均体重减低比例＞40%，极度消瘦，神情呆滞，肌张力低下，则为Ⅲ度营养不良（C对ABDE错）。营养不良临床分为三度，具体如下：1.Ⅰ度营养不良为体重减低15%～25%，腹部皮褶厚度为0.4～0.8cm。2.Ⅱ度营养不良为体重减低15%～40%，腹部皮褶厚度小于0.4cm。3.Ⅲ度营养不良为体重减低比例＞40%，腹部皮褶消失。